全脱出的年轻恒牙牙体应储存的介质错误的是
A. 生理盐水
B. 牛奶
C. 唾液
D. 血液
E. 干燥保存

正确答案：E。干燥保存

解析：牙齿储存：牙齿脱出后应该妥善保存牙齿，尽快到医院治疗。储存条件和储存时间的长短对于成功的愈合是非常重要的。生理盐水较好，其他液体如血液，组织培养液，牛奶和唾液也可作为储存液。切忌干燥保存。掌握“年轻恒牙外伤”知识点。